正确的是
A. 位于小网膜囊内
B. 胰尾位于胃结肠韧带内
C. 在胰颈后方有肝门静脉起始部
D. 胰腺前面隔腹膜与十二指肠相贴
E. 由肠系膜下动脉的分支供血

正确答案：C。在胰颈后方有肝门静脉起始部

解析：胰前面隔网膜囊与胃相邻(AD错)，胰尾位于脾肾韧带内(B错)，胰颈后方有肝门静脉起始部(C对)，胰由肠系膜上动脉的分支供血(E错)。